下列除哪一种疾病外，均为三氯乙烯作业的职业禁忌证
A. 神经系统疾病
B. 肝脏病
C. 肾脏病
D. 皮肤病
E. 心血管疾病

正确答案：E。心血管疾病